首先提出“合病与并病”之说的著作是
A. 《黄帝内经》
B. 《伤寒杂病论》
C. 《难经》
D. 《中藏经》
E. 《诸病源候论》

正确答案：B。《伤寒杂病论》

解析：该题考查合病与并病的出处，也考查了对于中医著作的理解。合病与并病属于六经辨证。《黄帝内经》奠定了中医学理论体系的基础（A错）。《伤寒杂病论》创立了辨证论治的诊治理论，包括《伤寒论》和《金匮要略》，前者以六经辨伤寒，后者以脏腑论杂病（B对）。《难经》补充了《黄帝内经》的不足（C错）。《中藏经》发展了阴阳学说，将脏腑学说的理论系统化（D错）。《诸病源候论》是病理学专著（E错）。